主动脉瓣关闭主要是由于
A. 心室肌收缩
B. 心房肌收缩
C. 主动脉瓣收缩
D. 主动脉压高于心室内压
E. 主动脉压低于心室内压

正确答案：D。主动脉压高于心室内压